前牙牙体缺损发病率较高的病因为
A. 龋病
B. 外伤
C. 磨损
D. 酸蚀症
E. 楔状缺损

正确答案：B。外伤

解析：牙外伤：交通事故、意外碰击或咬硬食物等可造成牙折，前牙外伤发病率较高。由于外力大小和作用部位的不同，造成缺损的程度也不同。轻者仅伤及切角或牙尖，重者可出现冠折、根折或冠根折。掌握“牙体缺损病因及影响”知识点。